医学上所指的职业病是泛指劳动者在其职业活动中
A. 政府规定的职业病
B. 接触职业性有害因素引起的特定疾病
C. 法定职业病
D. 职业史
E. 工作有关疾病

正确答案：B。接触职业性有害因素引起的特定疾病